某男，50岁。声音嘶哑3年余，伴干咳，五心烦热，心悸失眠，腰酸遗精，舌红苔少，脉细数属
A. 金实不鸣
B. 金破不鸣
C. 子喑
D. 失语
E. 短气

正确答案：B。金破不鸣

解析：患者久病声音嘶哑，伴干咳、五心烦热、心悸失眠、舌红苔少、脉细数等阴虚火旺之征，故诊断为金破不鸣（B对）。新病音哑或失音者，多属实证，多因外感风寒或风热袭肺，或痰湿壅肺，肺气不宣，清肃失司所致，即所谓“金实不鸣”（A错）。妇女妊娠后期出现音哑或失音者，称为妊娠失音，古称“子喑”，多因胞胎阻碍肾之络脉，肾精不能上荣于咽喉所致，一般分娩后即愈（C错）。失语为神志清晰，虽能发出声音，但表达障碍而言语难成，或语不成句，即“有声而无语”，多见于中风或脑外伤之后遗症（D错）。短气是指呼吸气急短促，气短不足以息，数而不相接续，似喘而不抬肩，喉中无痰鸣音（E错）。